碳酸钙用于肾衰竭患者降低血磷时，适宜的服药时间是
A. 餐前即刻
B. 清晨或睡前
C. 餐后2h
D. 餐中
E. 餐后即刻

正确答案：D。餐中

解析：本题考查碳酸钙的用药教育。碳酸钙用于肾衰竭者降低血磷时，应在餐中（D对）服用，最好是嚼服。